根据马斯洛的需要层次理论，人的最高需要是
A. 自我实现
B. 尊重
C. 爱与被爱
D. 安全
E. 生理

正确答案：A。自我实现

解析：马斯洛是美国人本主义心理学的主要代表。马斯洛认为人类行为的心理驱力是人的需要。他把人的需要称为“似本能”，需要有先天的遗传基础，但人的需要的满足与表现要取决于后天的环境，人的需要分为两大类、七个层次，由下而上依次是第一类需要属于匮乏性需要，包括生理需要、安全需要、归属与爰的需要和尊重的需要。匮乏性需要是人的基本生存需要，为人与动物所共有，必须从外界获取，可激发匮乏性动机并推动人的行为，促使人去获取他所缺乏的某种东西，一旦得到满足，紧张消除，兴奋降低，便失去动机。第二类需要属于成长性需要或存在需要，包括认识需要、审美需要、自我实现需要（A对）。成长性需要可激发成长性动机，为人类所特有，是一种超越了生存满足之后，发自内心的渴求发展和实现自身潜能的需要。不断趋向统一、整合的过程。人在满足高一层次的需要之前，至少必须先部分满足低一层次的需要。